抑酸剂西咪替丁可引起的典型不良反应是
A. 血糖升高
B. 血尿酸升高
C. 低镁血症
D. 定向力障碍
E. 胀气

正确答案：D。定向力障碍

解析：本题考查西咪替丁。抑酸剂西咪替丁可引起的典型不良反应是幻觉、定向力障碍（D对），除此之外，还有头痛、恶心、皮疹、便秘、乏力等不良反应。